临床探诊时得到的探诊深度一般
A. 可大于或小于龈沟组织学深度
B. 小于组织学龈沟深度
C. 等于组织学龈沟深度
D. 大于组织学龈沟深度
E. 视牙龈炎症程度而变

正确答案：D。大于组织学龈沟深度

解析：本题考查探诊深度。探诊深度指牙周袋底或龈沟底至龈缘的距离，对于人类健康牙龈进行组织学测量，龈沟深度约为0.69mm、1.5mm、1.8mm不等，但在临床上用牙周探针探测龈沟，通常探针会超过组织学的沟底，进入结合上皮，探诊深度大于组织学龈沟深度（D对ABC错），因此一般认为健康牙龈的龈沟探诊深度不超过2～3mm。一般探诊深度和牙龈炎症程度有一定的关系，炎症明显的部位探针可穿透结合上皮而进入有炎症的结缔组织，临床牙周探诊深度大于组织学上的龈沟，在无牙槽骨吸收的牙龈炎症，探诊深度不会随炎症程度变化（E错），因为牙龈炎未有附着丧失。